产后脉搏恢复正常的时间是
A. 产后3～4天
B. 产后7天
C. 产后10天
D. 产后21天
E. 产后42天

正确答案：B。产后7天

解析：产后脉搏略缓慢，每分钟60-70次，产后1周恢复正常（B对CDE错）。产后3-4天乳房血管、淋巴管极度充盈，乳房胀大，可出现发热，体温为37.8℃-39℃，称为泌乳热，持续4-16小时即下降，不属病态（A错）。